牙周袋的最佳解释是
A. PD≥3mm
B. PD≥5mm
C. PD≥3mm，未见上皮附着向根方增殖
D. 只与上皮附着向根方增殖有关
E. 与骨丧失有关，上皮附着可正常

正确答案：D。只与上皮附着向根方增殖有关

解析：本题考查牙周袋。真性牙周袋出现意味着上皮附着向根方增殖（D对），袋底位于釉牙骨质界的根方，即发生了附着丧失（E错）。PD是探诊深度，当患牙龈炎时，牙龈肿胀或增生是龈缘向冠方移动，探诊深度也可超过3mm，此时结合上皮的位置并未向根方迁移，称之为龈袋或假性牙周袋（ABC错）。